右眼视神经损伤，光照左眼，可见两眼的瞳孔变化为
A. 左眼大，右眼小
B. 右眼大，左眼小
C. 两侧瞳孔均散大
D. 两眼瞳孔均缩小
E. 左眼瞳孔缩小，右眼瞳孔无变化

正确答案：D。两眼瞳孔均缩小

解析：瞳孔对方反射的通路为：视网膜→视神经→视交叉→视束→上丘臂→顶盖前区→两侧动眼神经副核→动眼神经→睫状神经节→节后纤维→瞳孔括约肌收缩→两侧瞳孔缩小。当光照一侧眼时，该侧眼因直接对光反射而出现瞳孔缩小，对侧眼则因间接对光反射也出现瞳孔缩小。因而右眼视神经损伤，光照左眼，光线刺激可通过未损伤的左眼视神经传入最后使两眼瞳孔缩小（D对）（左瞳孔因直接对光反射缩小，右瞳孔因间接对光反射缩小）。